以动物的生理产物入药的中药材有
A. 鸡内金
B. 珍珠
C. 蟾酥
D. 牛黄
E. 蝉蜕

正确答案：C、E。蟾酥；蝉蜕